下列哪项不是气虚证的表现
A. 自汗
B. 神倦乏力
C. 头晕目眩
D. 耳鸣如蝉
E. 语声低微

正确答案：D。耳鸣如蝉

解析：气虚证患者气虚卫外不固，肌表不密，腠理疏松，故自汗（A对）；元气不足，脏腑机能减退，故神疲乏力（B对），少气懒言，气短，语声低微（E对）；气虚推动乏力，清阳不升，头目失养，则头晕目眩（C对）。耳鸣如蝉多见于肾精亏虚，或脾气亏虚，清阳不升，或肝阴、肝血不足，髓海失充，耳窍失养（D错，为本题正确答案）。